上入肺、中走脾、下达肾与膀胱的药是
A. 木香
B. 陈皮
C. 香附
D. 乌药
E. 青皮

正确答案：D。乌药

解析：乌药辛温香散，上入肺经，中入脾经，下达肾与膀胱经。善行气、散寒、温肾、止痛，治三焦寒凝气滞诸痛及阳虚遗尿、尿频（D对）。木香（A错）辛香温通，苦燥而降，主入脾、胃与大肠经，兼入三焦与胆经。陈皮（B错）辛温行散，苦燥芳化，入脾、肺经。香附（C错）辛散苦降，微甘能和，平而不偏。入肝经而善疏肝，入三焦经而善理气，故为疏肝理气之佳品，被李时珍誉为“气病之总司，女科之主帅”。青皮（E错）苦降下行，辛温行散，药力颇强，入肝、胆、胃经。